近3个月同等程度劳累所诱发的胸痛次数、程度及持续时间均增加，应诊断为
A. 初发型劳力性心绞痛
B. 稳定型劳力性心绞痛
C. 恶化型劳力性心绞痛
D. 自发性心绞痛
E. 变异型心绞痛

正确答案：C。恶化型劳力性心绞痛

解析：WHO心绞痛分型中把劳力性心绞痛（由运动或其他心肌耗氧量增加所诱发的心绞痛）分为三型：①稳定型劳力性心绞痛；②初发型劳力性心绞痛；③恶化型劳力性心绞痛。具体可参考实用内科学第14版P1468-P1469。其中恶化型劳力性心绞痛简称恶化型心绞痛，根据表3-4-1可知，恶化型心绞痛的临床表现主要为在相对稳定的劳力性心绞痛基础上心绞痛逐渐增强（疼痛更剧烈、时间更长或更频繁）。因此本题应诊断为恶化型劳力性心绞痛（C对）。初发劳力性心绞痛（A错）是指劳力性心绞痛病程在1个月以内。稳定型劳力性心绞痛（B错）是指劳力性心绞痛病程稳定1个月以上。自发性心绞痛（D错）是指胸痛发作与体力或脑力负荷引起心肌需氧量增加无关。变异型心绞痛（E错）是自发性心绞痛的一种，特征为静息心绞痛，常伴一过性的ST段抬高（P229），与本例不符。